苯丙酮尿症患儿主要的神经系统异常表现是
A. 肌张力增高
B. 行为异常
C. 智能发育落后
D. 惊厥
E. 腱反射亢进

正确答案：C。智能发育落后

解析：苯丙酮尿症患儿主要的神经系统异常表现是智力发育落后（C对）。其他神经系统临床表现有行为异常（B错），如兴奋不安、忧郁、多动、孤僻等。可有癫病小发作（D错），少数呈现肌张力增高（A错）和腱反射亢进（E错）。